在骨髓涂片细胞学检查的内容中，错误的是
A. 分数200个或500个有核细胞
B. 分数不同系列和不同发育阶段细胞
C. 计数粒红比例
D. 退化或破碎细胞在分数时应计入
E. 巨核细胞单独计数

正确答案：D。退化或破碎细胞在分数时应计入

解析：骨髓涂片细胞学检查的内容：1.骨髓有核细胞的增生程度（A对）；2.有核细胞分类（B对）；3.细胞形态观察；4.巨核细胞计数（E对）与分类；5.粒系细胞与红系有核细胞的比值（C对）；6.有无特殊细胞与寄生虫；7.其他如有丝分裂细胞计数，红系成熟比值计算，粒系成熟比值计算等。退化或破碎细胞为衰老的细胞，已失去正常细胞的功能，在分数时不计入（D错，为本题正确答案）。